膳食营养素参考摄入量是指在每日膳食中营养素供给量的基础上
A. 根据人的饮食习惯而制定的
B. 根据生产情况而制定的适宜需要量
C. 根据社会条件，经济条件而制定的量
D. 发展起来的一组每日平均膳食营养素摄入量的参考值
E. 以上都不是

正确答案：D。发展起来的一组每日平均膳食营养素摄入量的参考值

解析：膳食营养素参考摄入量是指在每日膳食中营养素的供给量基础上发展起来的一组每日平均膳食营养素摄入量的参考值。包括平均需要量、推荐摄入量、适宜摄入量、可耐受最高摄入量。掌握“合理营养指导”知识点。